光镜下观察釉质早期平滑面龋纵磨片，叙述正确的是
A. 釉柱横纹模糊
B. 生长线明显
C. 无色素沉着
D. 三角形顶部向着釉质表面
E. 三角形顶部为病变最晚的部分

正确答案：B。生长线明显

解析：光镜下观察釉质早期平滑面龋纵磨片，最早显示为病损区的釉柱横纹和生长线变得明显，以后逐渐有色素沉着。当釉质龋继续发展，病损呈三角形，其顶部向着釉牙本质界，基底部向着釉质表面，三角形顶部为病变最早、最活跃的部分。掌握“牙釉质龋”知识点。